氯丙嗪引起肌张力增高面容呆板动作迟缓肌肉震颤属于
A. 帕金森综合征
B. 静坐不能
C. 迟发性运动障碍
D. 急性肌张力障碍
E. 中枢抑制

正确答案：A。帕金森综合征

解析：锥体外系反应-是长期大量应用氯丙嗪时出现的最常见的副作用。主要表现为∶①帕金森综合征∶表现为肌张力增高、面容呆板、动作迟缓、肌肉震颤、流涎等（A对）②急性肌张力障碍∶一般出现于用药后1～5天，表现为强迫性张口、伸舌、斜颈、呼吸运动障碍及吞咽困难等（D错）③静坐不能∶表现为坐立不安、反复徘徊等（B错）④迟发性运动障碍∶表现为口面部不自主的吸吮、舔舌、咀嚼等刻板运动以及广泛性舞蹈样手足徐动症，停药后仍长期不消失（C错）。抑制中枢出现嗜睡、困倦、乏力等症状（E错）。